以下有关健康教育诊断的表述，哪项不正确
A. 确定或推测与目标人群主要健康问题有关的行为及影响因素
B. 不属于健康教育活动的步骤
C. 将为决定干预目标、策略和方法提供基本依据
D. 同计划制订一起被称为“计划设计”
E. 是健康教育活动成功与否的一个关键

正确答案：B。不属于健康教育活动的步骤